初治急性早幼粒细胞白血病首选的药物是
A. 全反式维A酸
B. 羟基脲
C. 1，25-（0H）₂-维生素D₃
D. 阿糖胞苷
E. 高三尖杉酯碱

正确答案：A。全反式维A酸

解析：初治急性早幼粒细胞白血病（M₃）首选的治疗是全反式维A酸（A对）。羟基脲（B错）（P579）主要用于慢性粒细胞白血病的治疗；阿糖胞苷和高三尖杉酯碱（DE错）（P576）主要用于急性粒细胞白血病（非APL）的治疗；1，25-（0H）₂-维生素D₃（C错）（P525）主要用于低钙血症的治疗。